某患者，放疗数周后出现中枢神经刺激症状，伴发热38℃，颈项强直，查脑脊液轻度混浊，淋巴细胞增多，蛋白含量增多。若疑脑脊液中可能存在真菌病原体进行分离培养时，最好使用哪种培养基
A. 血液琼脂培养基
B. 巧克力琼脂培养基
C. 沙保培养基
D. 亚碲酸钾培养基
E. 蛋白胨血清培养基

正确答案：C。沙保培养基